属于生长抑素适应证的是
A. 严重急性食管静脉曲张出血
B. 严重急性胃或十二指肠溃疡出血
C. 胰腺外科术后并发症的预防和治疗
D. 胰瘘、胆瘘和肠瘘的辅助治疗
E. 糖尿病酮症酸中毒的辅助治疗

正确答案：A、B、C、D、E。严重急性食管静脉曲张出血；严重急性胃或十二指肠溃疡出血；胰腺外科术后并发症的预防和治疗；胰瘘、胆瘘和肠瘘的辅助治疗；糖尿病酮症酸中毒的辅助治疗

解析：本题考查生长抑素的适应证。生长抑素能够治疗食管静脉曲张出血（A对）、上消化道出血（B对）、胰腺外科手术后并发症（C对）、膜、胆和肠瘘的辅助治疗（D对）、糖尿病酮症酸中毒（E对）。